执业药师执业时应
A. 遵守社会公德
B. 佩戴标明其姓名和执业药师称谓等内容的胸卡
C. 公示《执业药师资格证书》
D. 公示学历证书
E. 公示《执业药师注册证》

正确答案：A、B、E。遵守社会公德；佩戴标明其姓名和执业药师称谓等内容的胸卡；公示《执业药师注册证》